C3位羟基结合型的甾体化合物能被碱水解的多数属于
A. 强心苷类
B. 甾体皂苷类
C. 蟾毒类
D. 甾醇苷类
E. 蜕皮激素类

正确答案：A。强心苷类

解析：本题考查的是强心苷的水解反应。C3位羟基结合型的甾体化合物能被碱水解的多数属于强心苷类（A对）。强心苷的碱水解反应：强心苷的苷键不被碱水解。但碱可使强心苷分子中的酰基水解、内酯环裂解、双键移位和苷元异构化等。强心苷、甾体皂苷类（B错）、蟾毒类（C错）、甾醇苷类（D错）与蜕皮激素类（E错）均属于甾体类化合物，但只有强心苷可发生碱水解反应。